某婴儿五月龄足月顺产。近日来，夜间出汗，烦躁不安。体检发现枕秃。颅骨体检触及到乒乓球感，该婴儿最有可能缺乏的维生素是
A. 维生素A
B. 铁
C. 维生素C
D. 维生素D
E. 锌

正确答案：D。维生素D

解析：六个月以内的婴幼儿。体征有枕秃，血钙正常或稍低，血磷降低，AKP升高或正常，维生素D3下降，X线多正常（D对）。